胎黄湿热熏蒸证的治法是
A. 清热利湿
B. 解表化湿
C. 温脾化湿
D. 运脾燥湿
E. 利水渗湿

正确答案：A。清热利湿

解析：胎黄湿热熏蒸证是由于湿热邪毒蕴结脾胃，熏蒸肝胆，以致胆汁外溢皮肤、面目所致，故治疗时应清热利湿退黄（A对）。